44岁，牙龈反复肿胀一年，否认全身疾病，检查牙面中等量牙石，全口牙龈红肿，PD普遍4✕6mm，全口根尖片显示牙槽骨吸收超过根长的1/3，未达根长的1/2，诊断
A. 轻度慢性牙周炎
B. 中度慢性牙周炎
C. 重度慢性牙周炎
D. 局限型牙周炎
E. 广泛型牙周炎

正确答案：B。中度慢性牙周炎

解析：本题考查慢性炎周炎的分类。44岁，牙龈反复肿胀一年，否认全身疾病，检查牙面中等量牙石，全口牙龈红肿，PD普遍4✕6mm，全口根尖片显示牙槽骨吸收超过根长的1/3，未达根长的1/2，诊断为中度慢性牙周炎（B对）。中度：牙周袋≤6mm，附着丧失3～4mm，X线片显示牙槽骨水平型或角型吸收超过根长旳1/3，但不超过根长的1/2，符合题干。轻度慢性牙周炎（A错）：牙龈有炎症和探诊出血，牙周袋≤4mm，附着丧失1～2mm，X线片显示牙槽骨吸收不超过根长的1/3。可有或无口臭。重度慢性牙周炎（C错）：牙周袋＞6mm，附着丧失≥5mm，X线片显示牙槽骨吸收超过根长的1/2甚至根长的2/3，多根牙有根分叉病变，牙多有松动。炎症较明显或可发生牙周脓肿。局限型牙周炎（D错）：全口牙中有附着丧失和骨吸收的位点数≤30%者为局限型。广泛型牙周炎（E错）：全口牙中有附着丧失和骨吸收的位点数＞30%，则为广泛型。